锁骨下动脉的分支不出现
A. 椎动脉
B. 胸廓内动脉
C. 甲状颈干
D. 胸外侧动脉
E. 肋颈干

正确答案：D。胸外侧动脉

解析：椎动脉（A对）、胸廓内动脉（B对）、甲状颈干（C对）、肋颈干（E对）均为锁骨下动脉的分支。胸外侧动脉（D错，为本题正确答案）为腋动脉的分支。